患者男性，48岁。诊断为急性心肌梗死，经治好转，心电图ST段持续抬高。此时应考虑的并发症是
A. 左室扩大
B. 室壁瘤形成
C. 合并亚急性细菌性心内膜炎
D. 室间隔穿孔
E. 乳头肌功能失调或断裂

正确答案：B。室壁瘤形成

解析：急性心肌梗死的并发症为乳头肌功能失调或腱索断裂，心脏破裂，栓塞，心室壁瘤，心肌梗死后综合征。室壁瘤形成可见心电图ST2-T段持续抬高（B对）。左室扩大特征为：室壁运动幅度降低，左室射血分数＜0.4（A错）。亚急性细菌性心内膜炎特征为：中毒症状轻；病程数周至数月；感染迁移少见；病原体以草色链球菌多见，其次为肠球菌（C错）。室间隔穿孔X线示肺动脉段凸起，超声心动图示室间隔的回声在某一部位消失，磁共振显像显示缺损的部位及大小可明确诊断（D错）。乳头肌功能失调或断裂分为二尖瓣乳头肌收缩功能障碍，产生二尖瓣脱垂并关闭不全，引起心力衰竭。乳头肌腱索整体断裂少见，多发生在二尖瓣后乳头肌，心力衰竭明显，可迅速发生肺水肿而迅速死亡（E错）。